气溶胶是哪三种空气中化学物物理形态的统称
A. 雾、烟、蒸气
B. 烟、蒸气、粉尘
C. 蒸气、粉尘、雾
D. 粉尘、雾、烟

正确答案：D。粉尘、雾、烟

解析：本题考查气溶胶。气溶胶是烟、雾、粉尘（D对ABC错）三种空气中化学物物理形态的统称